前臂骨间膜
A. 是连于尺桡骨间的骨膜
B. 前臂旋前时最紧张
C. 前臂旋后时最紧张
D. 前臂半旋前时最紧张
E. 无

正确答案：D。前臂半旋前时最紧张

解析：前臂骨间膜是连结尺骨、桡骨骨间缘的骨间膜，并非骨膜（A错）。当前臂处于旋前（B错）或旋后（C错）位时，骨间膜松弛。前臂处于半旋前位时，骨间膜最紧张（D对）。